男，24岁，突然意识不清，跌倒，全身强直数秒钟后抽搐，咬破舌。2分钟后抽搐停止。醒后活动正常。首先应考虑的疾病是
A. 脑出血
B. 脑血栓
C. 蛛网膜下腔出血
D. 癫痫
E. 脑栓塞

正确答案：D。癫痫

解析：患者青年男性，突然意识不清（发作突然），跌倒，全身强直数秒钟后抽搐，咬破舌，2分钟后抽搐停止（短暂性），醒后活动正常。考虑诊断为癫痫（D对）全面强直-阵挛发作。脑出血（A错）常表现为对侧偏瘫、偏身感觉缺失和同向性偏盲等（P189）。脑血栓形成（B错）（P177）和脑栓塞（E错）（P185）发作一般会有肢体麻木、无力等前驱症状，会出现三偏症状、失语、人格改变等脑血管缺血表现，会有不同程度的后遗症。蛛网膜下腔出血（C错）会有典型的头痛、脑膜刺激征和眼部症状（P194）。